开口于肾小盏的是
A. 肾盂
B. 肾静脉
C. 肾动脉
D. 肾乳头
E. 肾柱

正确答案：D。肾乳头

解析：肾髓质由肾锥体构成，肾锥体尖部合并为肾乳头（D对）通过乳头孔开口于肾小盏，肾小盏汇成肾大盏，肾大盏汇成肾盂（A错）。肾柱为伸入肾锥体之间的肾皮质（E错）。